小脑出血的常见表现
A. 眩晕、频繁呕吐、头痛、病变侧共济失调
B. 意识丧失，双侧针尖样瞳孔、四肢瘫痪
C. 突发剧烈头痛、呕吐、脑膜刺激征，右侧偏瘫
D. 安静时发生偏瘫、偏身感觉障碍、瘫痪，无意识障碍
E. 活动中急骤发生瘫痪、偏身感觉障碍，伴短暂意识障碍

正确答案：A。眩晕、频繁呕吐、头痛、病变侧共济失调

解析：小脑主要维持躯体平衡，控制姿势和步态，调节肌张力和协调随意运动的准确性。小脑出血常由于高血压合并小脑上动脉分支硬化，当这一动脉分支破裂出血量较少时即可出现眩晕、频繁呕吐、头痛、病变侧共济失调（A对）等临床表现。意识丧失，双侧针尖样瞳孔，四肢瘫痪（B错）主要见于脑室出血（P190）。突发剧烈头痛呕吐脑膜刺激征，右侧偏瘫（C错）见于蛛网膜下腔出血（P194）。安静时发生偏瘫偏身感觉障碍瘫痪，无意识障碍（D错）见于腔隙性梗死（P187）。活动中急骤发生瘫痪偏身感觉障碍，伴短暂意识障碍（E错）常见于脑栓塞（P185）。